当归四逆汤的功用是
A. 温经散寒、养血通脉
B. 活血化瘀、通络止痛
C. 温阳补血、散寒通滞
D. 温经散寒、通络止痛
E. 活血化瘀、温经止痛

正确答案：A。温经散寒、养血通脉

解析：当归四逆汤方含当归养血和血；桂枝温经散寒，温通血脉；细辛温经散寒；白芍养血和营；通草通经脉；大枣、甘草益气健脾养血，诸药合用，共奏温经散寒，养血通脉之功（A对）。